一般类型急性上呼吸道感染，其病程一般约为
A. 1～3天
B. 3～5天
C. 5～7天
D. 7～9天
E. 9～14天

正确答案：B。3～5天

解析：一般类型急性上呼吸道感染，其病程一般约为3～5天。掌握“急性上呼吸道感染”知识点。